脱脂乳粉损失较多的营养素是
A. 乳清蛋白
B. 水溶性维生素
C. 脂溶性维生素
D. 乳糖
E. 钙

正确答案：C。脂溶性维生素

解析：本题考查脱脂乳粉损失较多的营养素。脱脂乳粉损失较多的营养素是脂溶性维生素（C对ABDE错），适合于腹泻的婴儿及要求低脂膳食的病人食用。